酒蒸后，即可消除刺激性，又能增强补脾润肺益肾作用的饮片是
A. 地黄
B. 女贞子
C. 黄精
D. 五味子
E. 肉苁蓉

正确答案：C。黄精

解析：本题考查的是黄精的炮制作用。酒蒸后，即可消除刺激性，又能增强补脾润肺益肾作用的饮片是黄精（C对）。黄精：【炮制作用】黄精味甘，平。归脾、肺、肾经。具有补气养阴、健脾、润肺、益肾的功能。生黄精具麻味，刺激咽喉。蒸后补脾润肺益肾功能增强，并可除去麻味，以免刺激咽喉。用于肺虚燥咳，脾胃虚弱，肾虚精亏。酒黄精能助其药势，使之滋而不腻，更好地发挥补益作用。地黄（A错）：【炮制作用】鲜地黄味甘、苦，性寒。归心、肝、肾经。具有清热生津、凉血、止血的功能。用于热病伤阴，舌绛烦渴，温毒发斑，吐血衄血，咽喉肿痛等症。①生地黄性味甘，寒。归心、肝、肾经。为清热凉血之品，具有清热凉血、养阴生津的功能。用于热入营血，温毒发斑，吐血衄血，热病伤阴，舌绛烦渴，津伤便秘，阴虚发热，骨蒸劳热，内热消渴。②熟地黄药性由寒转温，味由苦转甜，功能由清转补，熟地黄质厚味醇，滋腻碍脾，酒制主补阴血，且可借酒力行散，起到行药势、通血脉的作用。熟地黄性味甘，微温。归肝、肾经。具有补血滋阴，益精填髓的功能。用于血虚萎黄，心悸怔忡，月经不调，崩漏下血，肝肾阴虚，腰膝酸软，骨蒸潮热，盗汗遗精，内热消渴，眩晕，耳鸣，须发早白。③生地炭入血分凉血止血，用于吐血，衄血，尿血，便血，崩漏等。④熟地炭以补血止血为主，用于虚损性出血。酒蒸女贞子（B错）、五味子（D错）、肉苁蓉（E错）可增强疗效，缓和药性。